小儿肺炎痰热闭肺证的首选方剂是
A. 银翘散合麻杏石甘汤加减
B. 华盖散
C. 杏苏散
D. 五虎汤合葶苈大枣泻肺汤
E. 荆防败毒散

正确答案：D。五虎汤合葶苈大枣泻肺汤

解析：肺炎痰热闭肺证是由痰热俱甚，郁闭于肺所致，治以清热涤痰，开肺定喘，方药为五虎汤合葶苈大枣泻肺汤（D对）。银翘散合麻杏石甘汤加减（A错）其功用为辛凉宣肺，清热化痰，适用于肺炎之风热闭肺证。华盖散（B错）其功用宣肺解表，祛痰止咳，适用于肺炎之风寒闭肺证。杏苏散（C错）其功用为疏风散寒，宣肺止咳，适用于急性支气管炎之风寒咳嗽。荆防败毒散（E错）其功用为辛温解表，适应于风寒感冒。